双胎妊娠最常见的并发症为
A. 脐带脱垂
B. 产程延长，产后出血
C. 产褥感染
D. 胎头交锁
E. 胎膜早破

正确答案：B。产程延长，产后出血

解析：多胎妊娠孕妇并发症（1）妊娠期高血压疾病 （2）妊娠期肝内胆汁淤积症 （3）贫血 （4）羊水过多 （5）胎膜早破 （6）宫缩乏力 （7）胎盘早剥 （8）产程延长、产后出血（B对） （9）流产。围产儿并发症：（1）早产 （2）脐带异常（A错）（3） 胎头交锁及胎头碰撞 （4）胎儿畸形。其中胎头交锁（D错）多发生于第一胎儿为臀先露、第二胎儿为头先露者分娩时第一胎儿头部尚未娩出，而第二胎儿头部已入盆时，较少见。脐带脱垂（A错）多发生在双胎胎位异常或胎先露未衔接出现胎膜早破时，发生率较小。胎膜早破（E错）的发生率约达14%。经阴道分娩的双胎妊娠平均产后出血（B对）量≥500ml。产褥感染（C错）不是双胎妊娠的并发症。